能够与万古霉素合用成为治疗青霉素高度耐药的肺炎链球菌感染的首选药是
A. 利巴韦林
B. 氟康唑
C. 左氧氟沙星
D. 磺胺类药物
E. 四环素

正确答案：C。左氧氟沙星

解析：左氧氟沙星与万古霉素合用，首选用于治疗青霉素高度耐药的肺炎链球菌感染。掌握“氟康唑、利巴韦林及阿昔洛韦”知识点。